患者，女，49岁。发现右乳外上象限无痛、单发、质硬、边界欠清肿块，最常见的疾病是
A. 纤维腺瘤
B. 乳腺癌
C. 乳管内乳头状瘤
D. 乳腺结核
E. 乳腺炎

正确答案：B。乳腺癌

解析：49岁女性患者（45～50岁为乳腺癌的高发年龄段），发现右乳外上象限（乳腺癌好发部位），无痛，单发，质硬，边界欠清肿块（符合乳腺癌癌块特点），最常见的疾病是乳腺癌（B对）。纤维腺瘤（P242）（A错）多见于青年女性，主要表现为乳房外上象限的表面光滑，实性，有弹性，与周围组织分界清楚的肿块。乳管内乳头状瘤（P242）（C错）多见于40～50岁经产妇，主要表现为乳头无痛性血性溢液。乳腺结核（D错）多见于20～40岁的妇女，主要表现为乳房内一个或数个结节，无触痛，与周围组织分界不清，常有皮肤粘连。乳腺炎（P240）（E错）多见于产后哺乳期妇女，主要表现为乳房疼痛，局部红、肿、热、痛，并有寒战、高热、脉快等感染中毒症状。